中药牛蒡子的别名，错误的是
A. 大力子
B. 鼠黏子
C. 牛子
D. 梭罗子
E. 恶实

正确答案：D。梭罗子

解析：本题考查的是牛蒡子的别名。梭罗子为娑罗子的别名（D错，为本题正确答案）。牛蒡子别名：大力子（A对）、鼠黏子（B对）、牛子（C对）、恶实（E对）。梭罗子为娑罗子的别名。娑罗子别名：梭罗子。